男，50岁。持续胸痛8小时。喘憋2小时入院。既往无高血压病史。查体：BP150/70mmHg，端坐位，双肺可闻及少许细湿啰音，心界不大，心率110次/分，率齐，P₂＞A₂。心电图示I、aVL、V₁～V₆导联ST段抬高0.1～0.4mv。可见病理性Q波。该患者应慎用的药物治疗为
A. 皮下注射吗啡
B. 静脉注射毛花苷丙
C. 口服阿司匹林
D. 静脉注射硝酸甘油
E. 静脉注射呋塞米

正确答案：B。静脉注射毛花苷丙

解析：毛花苷丙（B对）属于洋地黄制剂，应避免使用。